治疗脑膜炎临床可选用的药物有
A. 磺胺嘧啶
B. 庆大霉素
C. 青霉素
D. 红霉素
E. 氯霉素

正确答案：A、B、C、E。磺胺嘧啶；庆大霉素；青霉素；氯霉素

解析：本题考查治疗脑膜炎的药物。治疗脑膜炎临床可选用的药物有磺胺嘧啶（A对）、庆大霉素（B对）、青霉素（C对）、氯霉素（E对）。磺胺嘧啶为磺胺类抗菌药，对脑膜炎球菌有抗菌作用。庆大霉素对革兰阴性杆菌的抗生素后效应较长，被用于治疗需氧革兰阴性杆菌所致的严重感染如脑膜炎。青霉素为临床上治疗多种感染的首选药，包括肺炎链球菌感染如脑膜炎、肺炎、中耳炎和菌血症等。红霉素（D错）为大环内酯类抗菌药物，主要作为青霉素过敏患者治疗感染的替代用药，还可治疗军团菌病、肺炎支原体肺炎、肺炎衣原体肺炎等。